桂枝汤服已须臾，啜热稀粥的意义是
A. 防止脾胃受损
B. 滋汗源，以防伤阴
C. 滋汗源，以防伤阳
D. 助汗并祛除外邪
E. 既防亡阴又防亡阳

正确答案：D。助汗并祛除外邪

解析：桂枝汤中五味药配伍发中有补，散中有收，邪正兼顾，阴阳并调。服已须臾，啜热稀粥一升余，以助药力，借水谷之精气，充养中焦，不但易为酿汗，更可使外邪速去而不致复感。（D对）。